新装饰的居室中，常常有一种可使人眼红、流泪和咳嗽的刺激性气体，这很可能是
A. SO₂
B. CO
C. CO₂
D. 甲醛
E. 氮氧化物

正确答案：D。甲醛

解析：本题考查刺激性气体。甲醛（D对ABCE错）是一种挥发性有机化合物，大量存在于多种装饰材料中，可对人体产生刺激作用，主要表现为眼红、流泪、咽 喉不适或疼痛、恶心呕吐、咳嗽胸闷、气喘、肺水肿，甚至死亡等。